患者，男，48岁。肝硬化5年，腹胀，按之软而不坚，胁下胀痛，纳少，食后胀甚，得嗳气稍减，小便短少，舌苔薄白腻，脉弦。其中医治法是
A. 疏肝理气，健脾利湿
B. 温中散寒，行气利水
C. 活血化瘀，化气行水
D. 清热利湿，攻下逐水
E. 滋养肝肾，化气利水

正确答案：A。疏肝理气，健脾利湿

解析：由于肝气郁滞，脾运不健，湿阻中焦，浊气充塞，故腹胀，按之软而不坚。肝失条达，络气痹阻，故胁下胀满疼痛。气滞中满，脾胃运化失职，故食少易胀，嗳气不适。气壅湿阻，水道不利，故小便短少。脉弦，苔白腻，为肝郁湿阻之象，故诊断患者为肝硬化之气滞湿阻证，治以疏肝理气，健脾利湿（A对）。温中散寒，行气利水为肝硬化寒水困脾证的治疗原则（B错）。活血化瘀，化气行水为肝硬化肝脾血瘀证的治则（C错）。清热利湿，攻下逐水为肝硬化湿热蕴结证的治疗原则（D错）。滋养肝肾，化气利水为肝硬化肝肾阴虚证的治疗原则（E错）。